饮水消毒常用的化学药剂是
A. 0₃
B. KMnO₄
C. 溴仿
D. 碘
E. 氯

正确答案：E。氯

解析：本题考查饮水消毒常用的化学药剂。饮水消毒常用的化学药剂是氯（E对ABCD错）。氯化消毒是指用氯或氯制剂进行饮水消毒的一种方法。供饮用水消毒的氯制剂主要有液氯、次氯酸钠、漂白粉[Ca（OCl）Cl]、漂白粉精[Ca（OCl）₂]和有机氯制剂等。